女，40岁。近三年经常于清晨突发晕厥，出冷汗，饮糖水后症状缓解。B超提示胰腺占位，约1.5cm。该肿瘤好发部位依次是
A. 胰头、胰颈、胰体
B. 胰头、胰体、胰尾
C. 胰颈、胰体、胰尾
D. 胰体、胰尾、胰头
E. 胰尾、胰体、胰头分布几率基本相等

正确答案：E。胰尾、胰体、胰头分布几率基本相等

解析：青年女性患者，常于清晨突发晕厥，出冷汗（空腹低血糖症状），饮糖水后症状缓解。B超提示胰腺占位。结合患者病史和B超检查，诊断考虑胰岛素瘤。胰岛素瘤的典型临床表现为Whipple三联症：空腹或运动后出现低血糖症状；症状发生时，血糖低于2.8mmol/L；进食或静脉推注葡萄糖可迅速缓解症状。该肿瘤在胰尾、胰体、胰头分布几率基本相等（E对）（七版外科学P587）。